肺心病肺动脉高压形成的主要原因是
A. 肺细小动脉痉挛
B. 肺血管玻璃样改变
C. 血容量增加
D. 右心室肥大
E. 左心衰竭

正确答案：A。肺细小动脉痉挛

解析：肺心病患者，由于呼吸功能障碍引起缺氧和呼吸性酸中毒，从而导致肺小动脉痉挛收缩（A对），肺循环阻力增加，成为肺动脉高压的主要原因；肺血管病变（B错）、血容量增加（C错）为次要因素；右心室肥大（D错）是肺动脉高压的结果，而左心衰竭（E错）与肺动脉高压无直接关系。